中国古代收方最多的方书是
A. 《普济方》
B. 《千金要方》
C. 《千金翼方》
D. 《和剂局方》
E. 《太平圣惠方》

正确答案：A。《普济方》

解析：本题考查的是主要方书典籍的内容。中国古代收方最多的方书是《普济方》（A对）。《普济方》：明•朱橚等撰，公元1390年撰成，1406年刊行。原为168卷，后改为426卷，收方61739首，原有插图239幅，保存了大量的民间验方。是中国古代收方最多的方书，为研究复方用药提供了极为珍贵的资料。朱橚为医药学的发展做出了较大的贡献，使明初及其以前的医药资料得以保存。《千金要方》（B错），即《备急千金要方》，唐·孙思邈撰著。成书于唐永徽三年（公元652年）。全书30卷。孙氏首重医德，序例中著有“大医习业”“大医精诚”两篇专论。孙氏集唐以前方书之大成，使之流传后世。《千金翼方》（C错）：唐•孙思邈撰著于公元682年。该书是《千金要方》的续编，与《千金要方》相辅相成。全书30卷。该书与《千金要方》对后世中医学发展具有重要的影响。《和剂局方》（D错），即《太平惠民和剂局方》、《局方》，宋代太医局编。全书10卷。内容涉及内科、外科、妇科、儿科、伤科、五官科等病证。每一门下分列医方，详其主治、配伍、药物炮制及制剂用法等。该书为宋代官府颁行，是我国第一部成药典。该书对后世影响颇大，其所载方剂至今在临床上多有应用。《太平圣惠方》（E错）：宋·王怀隐等编。全书共100卷，分1670门，收方16834首。该书以临床实用为目的，首详诊脉辨阴阳法，次叙处方用药法则，然后按科分叙各科病证和病因、病理以及方药的适应证和药物剂量。因证设方，药随方施，理法方药兼收并蓄。